下列各因素中哪项是引起DIC晚期出血的主要原因？
A. 血管通透性增加
B. 血小板减少
C. 继发性纤溶亢进
D. 纤维蛋白原减少
E. 凝血酶减少

正确答案：C。继发性纤溶亢进

解析：继发性纤溶亢进（C对ADE错）是引起DIC晚期出血的主要原因，DIC时产生的大量凝血酶及 F XIIa 等激活了纤溶系统，产生大量纤溶酶，导致纤溶亢进和 FDP的形成 。此期出血十分明显 。血小板减少（B错）出现在消耗性低凝期。